某男，36岁，患慢性肾炎5年，求中医诊治，希冀配服中成药，以缓解病情。症见浮肿，腰痛，乏力，小便不利，舌红，苔薄黄腻。证属湿热内蕴兼气虚。据此，医师处以肾炎四味片。3个月后，患者又来就诊。诉云：服上药后，浮肿减轻，尿量有增，乏力大减。3天前，因感冒咽痛，浮肿加重，不但肢体浮肿，又添眼睑浮肿，伴发热、微恶风，尿痛、尿急而少，纳可，大便尚调，尿检有蛋白与潜血。证属风水水肿。治当宣肺解表、利水消肿，医师处以麻黄、连翘、金银花、茯苓、猪苓、泽泻、车前子、赤小豆、芦根。7剂。方中能宣肺利水的药是
A. 连翘
B. 芦根
C. 泽泻
D. 麻黄
E. 车前子

正确答案：D。麻黄

解析：本题考查的是麻黄的功效。证属风水水肿。治当宣肺解表、利水消肿，医师处以麻黄、连翘、金银花、茯苓、猪苓、泽泻、车前子、赤小豆、芦根。7剂。方中能宣肺利水的药是麻黄（D对）。麻黄：【功效】发汗解表，宣肺平喘，利水消肿。连翘（A错）：【功效】清热解毒，疏散风热，消肿散结，利尿。芦根（B错）：【功效】清热生津，除烦止呕，利尿。泽泻（C错）：【功效】利水渗湿，泄热。车前子（E错）：【功效】利水通淋，渗湿止泻，明目，清肺化痰。